胎黄的病变脏腑在
A. 肝胆、脾胃
B. 心、小肠、肝胆
C. 肾、膀胱、脾胃
D. 肺、大肠、肝胆
E. 肾、膀胱、心肺

正确答案：A。肝胆、脾胃

解析：该题主要考查对胎黄的病变脏腑的掌握，理解记忆即可。胎黄的病变脏腑在肝胆、脾胃（A对）。其发病机理主要为脾胃湿热或寒湿内蕴，肝失疏泄，胆汁外溢而致发黄，日久则气滞血瘀。